辅助免疫应答的细胞是
A. 中性粒细胞
B. NK细胞
C. Th细胞
D. CTL
E. 浆细胞

正确答案：C。Th细胞